关于窝沟龋形态的描述，正确的是
A. 呈三角形，底部向着窝沟壁
B. 呈三角形，顶部向着釉牙本质界
C. 呈三角形，顶部向着窝沟壁
D. 呈同心圆形
E. 没有固定形状

正确答案：C。呈三角形，顶部向着窝沟壁

解析：本题考查牙釉质龋。关于窝沟龋形态的描述，正确的是呈三角形，顶部向着窝沟壁（C对）。窝沟龋龋损形态与平滑面不同，也呈三角形，但基底部朝向釉牙本质界，顶部向着窝沟壁。